乳牙迟萌的时间限度为
A. 婴儿出生后1年，萌出全部乳牙
B. 超过6个月后仍未见第一颗乳牙萌出
C. 超过1周岁后所有乳牙尚未全部萌出
D. 超过2周岁后所有乳牙尚未全部萌出
E. 超过1周岁后仍未见第一颗乳牙

正确答案：E。超过1周岁后仍未见第一颗乳牙

解析：婴儿出生后1年，萌出第一颗乳牙，均属正常范围。如果超过1周岁后仍未见第一颗乳牙萌出，超过3周岁乳牙尚未全部萌出为乳牙迟萌，此时需要查找原因，排除是否有“无牙畸形”。掌握“迟萌、多生牙和融合牙”知识点。